对碳青霉烯类药物不敏感的药物是
A. 肺炎链球菌
B. 大肠埃希菌
C. 铜绿假单胞菌
D. 军团菌
E. 厌氧菌

正确答案：D。军团菌

解析：本题考查碳青霉烯类药物抗菌谱。军团菌（D错，为本题正确答案）不在碳青霉烯类抗菌谱内。碳青霉烯类抗菌谱包括革兰阴性菌（包括产β-内酰胺酶的流感嗜血杆菌和淋病奈瑟菌、肠杆菌科细菌（B对）及铜绿假单胞菌（C对）），包括产ESBL菌株；厌氧菌（E对）（包括脆弱拟杆菌）；革兰阳性菌（A对）（包括粪肠球菌和李斯特菌）。